肾癌典型的临床表现是
A. 消瘦、肿块和疼痛
B. 高血压、肿块和疼痛
C. 血尿、肿块和疼痛
D. 发热、肿块和疼痛
E. 水肿、肿块和疼痛

正确答案：C。血尿、肿块和疼痛

解析：肾癌典型的临床表现是血尿、腰痛和腹部肿块（C对），被称为肾癌的“三联症”。消瘦（A错）、高血压（B错）、发热（D错）等为副瘤综合症的一般表现，可见于多种全身疾病，不具有特异性。肾癌患者一般不会出现水肿（E错）的表现。